女，30岁，近3个月来自觉两侧嚼肌、颞肌酸痛，可能为
A. 根尖周炎
B. 牙周炎
C. 充填物造成的早接触点
D. 磨牙症
E. 精神紧张

正确答案：E。精神紧张

解析：本题考查嚼肌、颞肌酸痛的病因。精神紧张（E对）在临床上被认为与TMD相关，TMD可单独累及颞下颌关节或咀嚼肌群，产生肌痛，下颌运动异常和伴功能障碍及关节弹响等等。根尖周炎（A错）分为急、慢性根尖周炎。慢性根尖周炎主要表现为患牙咬合痛；急性根尖周炎表现为三阶段：根尖周脓肿（跳痛、咬合剧痛）、骨膜下脓肿（剧烈跳痛和咬合痛）、黏膜下脓肿（自发性胀痛和咬合痛）。牙周炎（B错）可导致牙齿支持组织的破坏，即牙周袋形成并有炎症，附着丧失和牙槽骨吸收，不会引起肌肉酸痛。当患者的牙存在充填物造成的早接触点（C错）时，产生咬合痛，多可引起创伤性牙周膜炎，若未及时调（牙合），有时可引起急性牙周膜炎，疼痛可定位。磨牙症（D错）也称夜磨牙，是在非进食情况下发生不自主的咀嚼运动，多在夜间睡眠中发生，会导致明显牙齿磨损。